甾类药物按其结构特点可分为
A. 肾上腺皮质激素
B. 性激素
C. 雌甾烷
D. 雄甾烷
E. 孕甾烷

正确答案：C、D、E。雌甾烷；雄甾烷；孕甾烷

解析：本题考查甾体激素类药物。甾体激素类药物按结构可分为孕甾烷（E对）、雄甾烷（D对）和雌甾烷（C对）；按其类别又可分为肾上腺皮质激素（A错）和性激素（B错）两大类。